桡动脉
A. 是掌浅弓的主要组成动脉
B. 常与桡神经伴行，经桡神经沟
C. 行于肱桡肌腱与桡侧腕屈肌腱之间
D. 发出骨间前动脉
E. 无

正确答案：C。行于肱桡肌腱与桡侧腕屈肌腱之间

解析：桡动脉行于肱桡肌腱与桡侧腕屈肌腱之间（C对）。其末端与尺动脉掌深支相吻合形成掌深弓（A错）。